治疗滴虫病宜选用
A. 甲硝唑
B. 甲苯咪唑
C. 吡喹酮
D. 氯喹
E. 恩波维铵

正确答案：A。甲硝唑

解析：本题考查甲硝唑。甲硝唑（A对）可作为阴道滴虫病的首选药。甲苯咪唑（B错）是治疗蛔虫病、蛲虫病、钩虫病和鞭虫病的首选药。吡喹酮为（C错）广谱抗蠕虫药。氯喹（D错）为抗疟疾药。恩波维铵（E错）为杀蛲虫药。